下列关于血尿素氮的改变及临床意义的叙述，正确的是
A. 上消化道出血时，血尿素氮减少
B. 大面积烧伤时，血尿素氮减少
C. 严重的肾盂肾炎，血尿素氮减少
D. 血尿素氮对早期肾功能损害的敏感性差
E. 血尿素氮对早期肾功能损害的敏感性强

正确答案：D。血尿素氮对早期肾功能损害的敏感性差

解析：血尿素氮对早期肾功能损害的敏感性差（D对E错）。上消化道出血时（A错）、大面积烧伤时（B错）、严重的肾盂肾炎（C错）时，血尿素氮增高。